既能补肾助阳，又能润肠通便的药物是
A. 肉苁蓉
B. 淫羊藿
C. 巴戟天
D. 骨碎补
E. 补骨脂

正确答案：A。肉苁蓉

解析：肉苁蓉的功效是补肾阳，益精血，润肠通便（A对）。淫羊藿（B错）的功效是补肾阳，强筋骨，祛风湿。巴戟天（C错）的功效是补肾阳，强筋骨，祛风湿。骨碎补（D错）的功效是活血疗伤止痛，补肾强骨，外用消风祛斑。补骨脂（E错）的功效是温肾助阳，纳气平喘，温脾止泻，外用消风祛斑。